患者，女，22岁，未婚。经期延后，量少、色暗、有血块，腹痛喜热，畏寒，舌暗苔白，脉沉紧。其治法是
A. 暖宫止痛调经
B. 理气止痛调经
C. 活血行气调经
D. 扶阳祛寒调经
E. 温经散寒调经

正确答案：E。温经散寒调经

解析：根据题目可知，患者经期延后，量少色黯，有血块，并伴有腹痛喜暖，畏寒；舌暗苔白，脉沉紧实寒之证。故患者应感受寒邪，影响气血运行，血为寒凝，冲任滞涩，血海不能按时满溢，故周期延后，量少；寒凝冲任，故经色黯有块；寒邪克于胞中，气血运行不畅，“不通则痛”，故小腹冷痛，得热后气血稍通，故喜热；舌暗苔白，脉沉紧均为实寒之证。故在治疗时选择温经散寒调经（E对）。寒凝胞宫的虚寒证多用暖宫止痛调经法（A错）。月经后期气滞证多用理气止痛调经法（B错）。月经过多血瘀证活血行气调经治法（C错）。扶阳祛寒调经治法多用于月经后期虚寒证（D错）。